兴奋性突触后电位是由于突触后膜提高了对下列哪些离子的通透性而引起的
A. Cl⁻、Na⁺，尤其是Cl⁻
B. Na	⁺、K⁺，尤其是Na⁺
C. K⁺、Na⁺，尤其是K⁺
D. Ca²⁺、 Na⁺，尤其是Ca²⁺
E. Ca²⁺、Na⁺，尤其是Na⁺

正确答案：B。Na	⁺、K⁺，尤其是Na⁺